硅胶薄层板使用前在110℃加热30分钟，这一过程称为
A. 去活化
B. 活化
C. 再生
D. 饱和
E. 平衡

正确答案：B。活化